关于氟牙症的病理表现，以下正确的是
A. 缺陷区釉柱末端不清晰
B. 釉柱之间可见釉质矿化不良
C. 釉质深部过度矿化
D. 牙本质界弧形模糊
E. 釉质表层钙化不良

正确答案：B。釉柱之间可见釉质矿化不良

解析：形态学观察氟牙症牙面显示，发育不全使釉面横纹中断，在发育缺陷区牙面上可见清楚的釉柱末端。镜下可见釉质矿化不良，尤其是在釉柱之间及有机物较多的薄弱处。但釉质表层过度矿化，釉柱方向不规则，釉质牙本质界的弧形结构较正常牙更加明显。掌握“氟牙症、先天性梅毒牙与牙本质形成缺陷”知识点。